为避免继发真菌感染，使用后应立即漱口的药物是
A. 沙丁胺醇气雾剂
B. 孟鲁司特片
C. 布地奈德福莫特罗吸入剂
D. 羧甲司坦口服液
E. 氨茶碱片

正确答案：C。布地奈德福莫特罗吸入剂

解析：本题考查布地奈德福莫特罗吸入剂。为避免继发真菌感染，使用后应立即漱口的药物是布地奈德福莫特罗吸入剂（C对）。吸入型糖皮质激素长期给药可能引起患者口腔、咽喉部的白假丝酵母菌感染，表现为声音嘶哑、咽部不适，吸药后用水漱口及局部应用抗霉菌药物可降低发生率。沙丁胺醇气雾剂（A错）、孟鲁司特片（B错）、羧甲司坦口服液（D错）、氨茶碱片（E错）使用后均不需要立即漱口。